上颌神经
A. 为三叉神经的三大分支之一
B. 终支为眶下神经
C. 分布于鼻腔、软腭等处黏膜
D. 布于上颌牙、牙龈
E. 以上都正确

正确答案：E。以上都正确

解析：三叉神经的三大分支为眼神经、上颌神经（A对）、下颌神经。上颌神经经眶下裂入眶后移行为终末支称眶下神经（B对），眶下神经最后穿出眶下孔到达面部。上颌神经在穿出眶下孔前，沿途发出分支分布于上颌牙、牙龈（D对）及鼻腔、软腭等处黏膜（C对）。故E为本题正确答案。